患者，女，26岁，妊娠5个月。下中切牙之间牙龈乳头处形成一肿物2个月，色紫红，易出血。最可能的诊断是
A. 纤维性牙龈瘤
B. 牙龈癌
C. 化脓性肉芽肿
D. 孕瘤
E. 牙周脓肿

正确答案：D。孕瘤

解析：本题考查孕瘤的诊断。患者女，妊娠5个月。牙龈乳头处一肿物2个月，色紫红，易出血，综合考虑诊断为孕瘤（D对）。妊娠期龈瘤（也称孕瘤）通常始发于妊娠第3个月，迅速增大，患者常因出血和妨碍进食而就诊。纤维性牙龈瘤（A错）表现为增生牙龈颜色正常，触之坚实，口内大部以至全部牙龈呈弥漫性增生，表面光滑或呈结节状，点彩明显，不易出血。牙龈癌（B错）临床可表现为龈缘区溃疡、红肿充血，晚期症状表现范围较大，牙龈、周边黏膜、唇部、下颌颈部、口咽部还有周边骨头皆会被侵犯。化脓性肉芽肿（C错）表现为个别龈乳头的无痛性肿胀、突起的瘤样物，多数病变表面有溃疡和脓性渗出物。牙周脓肿（E错）表现为在牙龈边缘或者是牙龈乳头形成半球形的隆起，质地比较软，按压牙龈的时候从牙龈沟溢脓。以上4中疾病的临床表现均与本病例中不符合，应诊断为孕瘤。